下列哪项不是影响（牙合）力的因素
A. 性别、年龄
B. 釉质钙化的程度
C. 咀嚼习惯
D. （牙合）力线的方向
E. 张口距离

正确答案：B。釉质钙化的程度

解析：影响（牙合）力因素①性别：一般男性（牙合）力较女性大。②年龄：最大（牙合）力随年龄增加直到青春期。③咀嚼习惯：对（牙合）力有很大影响。咀嚼侧较非咀嚼侧的（牙合）力较大。吃韧性食物时，咀嚼明显发生在第一磨牙和第二前磨牙区。④（牙合）力线的方向：牙齿承受轴向（牙合）力较侧向（牙合）力为大。⑤张口的距离：颌间距离过大过小，皆可影响（牙合）力，使之下降。⑥其他：（牙合）力的大小与面部骨骼有关。掌握“咀嚼过程、类型，咀嚼周期及生物力”知识点。